发生外科感染的必要条件不包括
A. 外界病菌大量侵入组织
B. 人体正常菌群变成病菌
C. 病菌在组织内大量繁殖
D. 人体抵抗力有一定缺陷
E. 组织内的有氧环境

正确答案：E。组织内的有氧环境

解析：外科感染的发生发展，主要取决于三个因素（七版黄家驷外科学）：病原微生物、机体防御功能和环境。细菌污染是感染发生的前提，可来源于外界（外源性）（A对）也可来源于病人自身（内源性，在外科感染中占主要地位）（B对）。细菌在体内先要经历一个适应定植和繁殖的过程。污染细菌数量越多，繁殖的越快，感染的机会越大（C对）。人体抵抗力有一定缺陷（D对），为细菌逃过免疫从而发生感染提供了条件。环境：炎热的气候，潮湿的环境、狭小空间里污浊的空气都能促进感染的发生。而组织内有氧环境（E错，为本题正确答案）不是外科感染的必要条件，如破伤风梭菌只有在厌氧环境下才能生长繁殖而致病。